最易形成潜伏感染的病毒是
A. 麻疹病毒
B. 流感病毒
C. 狂犬病毒
D. 脊髄灰质炎病毒
E. 水痘-带状疱疹病毒

正确答案：E。水痘-带状疱疹病毒

解析：潜伏感染是某些病毒在显性感染或隐性感染后，病毒基因存在细胞内，有的病毒潜伏于某些组织器官内而不复制，但在一定条件下，病毒被激活而又开始复制，使疾病复发，疱疹病毒属的全部病毒：HSV、带状疱疹病毒（E对）、巨细胞病毒、EB病毒和人疱疹病毒6型，均可引起潜伏感染。麻疹病毒（A错）是麻疹的病原体，以皮丘疹、发热及呼吸道症状为特征，麻疹传染性极强，易感者接触后几乎全部发病（P243）。流感病毒（B错）是人流行性感冒的病原体，人群普遍易感，表现为显性感染（P224表23-3）。狂犬病毒（C错）是一种嗜神经病毒，可引起狂犬病（恐水症），是目前死亡率最高的传染病，一旦发病，死亡率近乎100%，不存在潜伏感染（P313）。脊髓灰质炎病毒（D错）是脊髓灰质炎的病原体，主要侵犯脊髓前角运动神经细胞，导致急性弛缓性肢体麻痹，感染者大部分表现为隐性感染，另有少部分为顿挫感染（P252）。